某患者脊髓腰段横断外伤后，出现尿失禁，其机制是
A. 脊髓初级排尿中枢损伤
B. 初级排尿中枢与大脑皮层失去联系
C. 排尿反射传入神经受损
D. 排尿反射传出神经受损
E. 膀胱平滑肌功能障碍

正确答案：B。初级排尿中枢与大脑皮层失去联系